男，31岁。突发剧烈头痛1小时，以下枕部为著，伴喷射状呕吐3次。查体：痛苦面容，全身大汗，脑膜刺激征阳性。可能的诊断是
A. 脑栓塞
B. 蛛网膜下腔出血
C. 脑梗死
D. 脑脓肿
E. 急性病毒性脑炎

正确答案：B。蛛网膜下腔出血

解析：青年男性，突发剧烈头痛伴喷射状呕吐（蛛网膜下腔出血的特征性症状），查体：痛苦面容，全身大汗，脑膜刺激征阳性（蛛网膜下腔出血特征性体征），根据患者的临床症状及体征，考虑最可能的诊断为蛛网膜下腔出血（B对），该病是由各种病因引起颅内和椎管内病变血管突然破裂，血液流至蛛网膜下腔所致，主要表现为突发剧烈疼痛并伴有呕吐。脑栓塞（A错）多急性起病，常表现为上肢瘫痪重，下肢瘫痪轻。脑梗死（C错）多见于中老年人，多于安静或者睡眠中发作，一般有意识障碍，严重者威胁生命。脑脓肿（D错）主要临床表现为全身感染、颅内压增高及局灶性神经功能障碍。急性病毒性脑炎（E错）主要表现未发热、头痛、嗜睡、腹痛、腹泻等症状。